头晕耳鸣，腰膝酸软。治疗应首选
A. 固阴煎
B. 六味地黄丸
C. 大补元煎
D. 左归丸
E. 归肾丸

正确答案：D。左归丸

解析：崩漏是月经的周期、经期、经量发生严重失常的病证，是指经血非时暴下不止或淋漓不尽，前者谓之崩中，后者谓之漏下，故“经乱无期，出血淋漓不尽”属于漏下。肾阴亏虚，冲任失守，故经乱无期，淋漓不尽。阴虚则内热，故出现血色鲜红，质稍稠。肾阴亏虚，不能上达头窍，故出现头晕，肾开窍于耳，肾阴亏虚则耳鸣。腰为肾之府,肾精亏虚则出现腰膝酸软。崩漏之肾阴虚首选左归丸合二至丸以滋肾益阴，固冲止血（D对）。固阴煎补肾益气，固冲调经，用以治疗月经先期之肾气虚证（A错）。六味地黄丸补肾阴，为干扰选项（B错）。大补元煎长于大补元气，益精养血，用于治疗月经后期之血虚证，妊娠贫血之肝肾不足（C错）。归肾丸补肾兼顾肝脾，重在益精养血，用以治疗月经过少之肾虚证（E错）。